在硫酸存在下，与甲醛反应生成玫瑰红色产物
A. 异烟肼
B. 肾上腺素
C. 苯巴比妥
D. 盐酸利多卡因
E. 磺胺甲噁唑

正确答案：C。苯巴比妥

解析：本题考查苯巴比妥的鉴别。苯巴比妥（C对）的鉴别反应：（1）与亚硝酸钠-硫酸反应；（2）与甲醛-硫酸反应生成玫瑰花色物质；（3）红外光谱法；（4）丙二酰脲类的鉴别银盐反应、铜盐反应。